严重环境污染引起的区域性疾病
A. 公害病
B. 职业病
C. 食物中毒
D. 地域性疾病
E. 地方性疾病

正确答案：A。公害病

解析：公害病（A对）指由人类活动造成严重环境污染引起公害所发生的地区性疾病。职业病（B错）是指企业、事业单位和个体经济组织的劳动者在职业活动中，因接触粉尘、放射性物质和其他有毒、有害物质等因素而引起的疾病。食物中毒（C错）是指患者所进食物被细菌或细菌毒素污染，或食物含有毒素而引起的急性中毒性疾病。地域性疾病和地方性疾病（D、E错）均指有严格区域特点的一类疾病。